治疗急症宜选用
A. 郄穴
B. 原穴
C. 募穴
D. 背俞穴
E. 络穴

正确答案：A。郄穴

解析：郄穴是治疗本经和相应脏腑病证的重要穴位，尤其在治疗急症方面有独特的疗效（A对）。原穴是脏腑原气经过和留止的地方，主要用于治疗相关脏腑的疾病，也可协助诊断（B错）。络穴是络脉从本经别出的部位，除可治疗其络脉的病证外，又可治疗表里两经的病证（E错）。由于背俞穴和募穴都是脏腑之气输注和会聚的部位，在分布上大体与对应的脏腑所在部位的上下排列相接近，因此主要用于治疗相关脏腑的病证第十版针灸学（CD错）。